患者，女，75岁，戴用全口义齿一月，复查时自述戴牙后一直感觉咀嚼无力，口角下垂，检查发现（牙合）关系正常，息止间隙偏大。最好的处理方法
A. 重衬
B. 重新制作义齿
C. 嘱患者慢慢适应
D. 加深（牙合）面沟窝
E. 调整咬合

正确答案：B。重新制作义齿

解析：本题考查全口义齿颌位关系及上（牙合）架。垂直距离过低，只能重新制作义齿（B对）恢复正确的垂直距离。只加高下颌后牙会导致前牙开（牙合），咬合不平衡等。调（牙合）、缓冲不能增加垂直距离，也不能利用基托重衬来抬高垂直距离。